《中国药典》的凡例部分
A. 起到目录的作用
B. 有标准规定，检验方法和限度，标准品、对照品，计量等内容
C. 介绍中国药典的改革
D. 收载药品质量标准分析方法验证等指导原则
E. 收载有制剂通则

正确答案：B。有标准规定，检验方法和限度，标准品、对照品，计量等内容

解析：本题考查药典。《中国药典》的凡例部分有标准规定，检验方法和限度，标准品、对照品，计量等内容（B对）。凡例是对《中国药典》正文、通则与药品质量检定有关的共性问题的统一规定，在《中国药典》各部中列于正文之前。凡例内容包括：①总则； ②正文； ③通则； ④名称与编排； ⑤项目与要求； ⑥检验方法和限度；⑦标准品与对照品； ⑧计量；⑨精确度；⑩试药、试液、指示剂； ⑪动物试验；⑫说明书、包装和标签。共12类39 条，对各条内容的定义与基本要求作出统一规定。《中国药典》标准体系构成包括：凡例、通则及各部的标准正文三部分（AC错）。收载药品质量标准分析方法验证等指导原则（D错）的为《中国药典》通则部分。收载有制剂通则（E错）的为《中国药典》通则部分。